在卫生服务需求中，造成没有需要的需求的原因是
A. 卫生服务的信息缺乏
B. 对医院的规模和设施的盲目追求
C. 人们对医疗产品的信赖
D. 卫生工作者的服务态度
E. 不良的就医和行医

正确答案：E。不良的就医和行医

解析：在卫生服务需求中，不良的就医和行医（E对）两种行为，会造成没有需要的需求。卫生服务的信息缺乏（A错）、对医院的规模和设施的盲目追求（B错）、人们对医疗产品的信赖（C错）和卫生工作者的服务态度（D错）均是造成没有需要的需求的具体表现。